可与PPI、铋剂联合使用治疗幽门螺杆菌感染的药物是
A. 克拉霉素
B. 替考拉宁
C. 美罗培南
D. 大观霉素
E. 氯霉素

正确答案：A。克拉霉素

解析：本题考查药物的使用。克拉霉素（A对）为大环内酯类抗菌药物，可与PPI、铋剂合用治疗幽门螺杆菌引起的胃溃疡。替考拉宁（B错）为多肽类抗菌药物，用于各种革兰阳性菌感染。美罗培南（C错）为β内酰胺类抗菌药物，用于由单一或多种敏感细菌引起的成人及儿童的肺炎（医院获得性肺炎）、尿路感染、腹腔内感染等病。大观霉素（D错）为氨基糖苷类抗菌药物，用于治疗淋病奈瑟菌所致的尿道炎、前列腺炎、宫颈阴道炎等。氯霉素（E错）为酰胺醇类抗菌药物，用于治疗某些严重感染。